含有核黄素的辅酶是
A. FMN
B. HS-CoA
C. NAD⁺
D. NADP⁺
E. CoQ

正确答案：A。FMN